人生会受到无数应激源的作用，只有那些对人有意义的刺激物才能引起心理应激反应，这些事物是否对人有意义，很大程度上取决于
A. 应激源的强度
B. 应激源的性质
C. 应激源的数量
D. 人的认知评价
E. 人的智力水平

正确答案：D。人的认知评价